动脉血压升高时能引起
A. 窦神经传入冲动增加
B. 主动脉神经传入冲动减少
C. 心迷走中枢兴奋
D. 交感缩血管中枢兴奋
E. 心交感中枢兴奋

正确答案：C。心迷走中枢兴奋